关于子宫峡，下列叙述正确的是
A. 位于子宫颈阴道部和子宫颈阴道上部之间
B. 非妊娠时长约3cm
C. 妊娠期伸展变长
D. 妊娠称“子宫颈上段”
E. 无

正确答案：C。妊娠期伸展变长

解析：子宫峡位于子宫颈上端与子宫体之间（A错），未妊娠期长约1cm（B错），妊娠期子宫峡伸展变长（C对）称为“子宫下段”（D错）。